下列治疗军团菌病的首选药物是
A. 青霉素G
B. 红霉素
C. 四环素
D. 氯霉素
E. 头孢唑啉

正确答案：B。红霉素

解析：大环内酯类抗生素如红霉素（B对）主要是通过抑制细菌蛋白质的合成来发挥抗菌作用，其抗菌谱较窄，对大多数G⁺菌、厌氧球菌和部分G⁻菌有强大抗菌活性，也对嗜肺军团菌、弯曲菌、支原体、衣原体、弓形虫、非典型分枝杆菌等也具有良好作用。青霉素G（A错）（P369）可用于治疗敏感的G⁺球菌和杆菌、G⁻球菌及螺旋体所致的感染。四环素（C错）（P391）对G⁺菌的作用不及青霉素，对G⁻菌的作用不及氨基糖苷类抗生素，现由于耐药菌株日益增多和药物的不良反应，一般不做首选药。氯霉素（D错）（P393）主要用于革兰阴性菌的感染。头孢唑啉（E错）（P373）为第一代头孢菌素，对G⁺菌的作用较强。